下列对乳牙的描述，哪项是正确的
A. 完整的乳牙列有助于儿童的消化吸收
B. 健康的乳牙能刺激颌骨的正常发育
C. 乳牙早失是造成牙列畸形的原因之一
D. 位置正常而健康的乳牙可引导恒牙的正常萌出
E. 以上都对

正确答案：E。以上都对

解析：本题考查乳牙的重要作用。乳牙对儿童的生长发育、正常恒牙列的形成等都起重要的作用：1.有助于儿童的生长发育，婴幼儿时期是生长发育的旺盛期，完整的乳牙列有助于儿童的消化吸收（A对），有利于生长发育。健康的乳牙能发挥良好的咀嚼功能，给颌、颅底等软组织以功能性刺激，促进其血液、淋巴循环，增强其代谢，进而刺激颌骨的正常发育（B对）。2.引导恒牙的萌出及恒牙列的形成：乳牙的存在为继承恒牙的萌出预留间隙。若第二乳磨牙过早丧失，第一恒磨牙失去诱导面，常发生近中移位或斜面向近中，所以乳牙早失是造成牙列畸形的原因之一（C对）。乳牙对恒牙的萌出具有一定的诱导作用，位置正常而健康的乳牙可引导恒牙的正常萌出（D对）。3.辅助发音。4.有利于美观及心理健康。（ABCD均对，故E为本题的正确答案）。